男，40岁。饮酒后突发腹痛24小时，腹痛剧烈，呈持续性，腹痛从上腹部很快波及全腹，伴恶心呕吐，查体：腹部膨隆，全腹肌紧张，有压痛反跳痛，脐周Cullen征（+）。血清淀粉8500U/L（Somogyi法）。决定手术治疗，术中常规处理措施中最重要的是
A. 检查是否完全性脾破裂
B. 判断是否绞窄性肠梗阻
C. 空肠造瘘或胃造瘘
D. 探查并解除胆道梗阻
E. 坏死组织清除加引流术

正确答案：E。坏死组织清除加引流术

解析：青年男性患者，饮酒（急性胰腺炎常见病因）后突发腹痛，腹痛剧烈，呈持续性，腹痛从上腹部很快波及全腹，伴恶心呕吐（急性胰腺炎的典型临床表现）。查体：腹部膨隆，全腹肌紧张，有压痛、反跳痛（典型的腹膜刺激征表现，提示病情较重），脐周Cullen征阳性（提示胰腺出血坏死）。血清淀粉8500U/L（支持胰腺炎诊断）。综合该患者的病史、体查及实验室检查，诊断考虑为急性出血坏死性胰腺炎（AB错）。决定手术治疗，术中常规处理措施中最重要的是坏死组织清除加引流术（E对），以避免继发感染、胰腺或胰周脓肿等并发症。空肠造瘘或胃造瘘（C错）可作为肠内营养的输入途径；探查并解除胆道梗阻（D错）是胆源性胰腺炎的处理原则，但均不是术中最重要的处理措施。